关于土壤环境背景值不正确的是
A. 环境背景值实际上是一个相对的概念
B. 是指相对不受污染情况下，环境要素的基本化学组成
C. 在未受污染影响的情况下，土壤中化学元素的自然组成及其含量水平，又称环境本底值
D. 同一环境要素在不同的地理、地质环境中，自然背景值是相同的
E. 化学元素含量超过了环境背景值和能量分布异常，表明环境可能受到了污染

正确答案：D。同一环境要素在不同的地理、地质环境中，自然背景值是相同的

解析：本题考查土壤环境背景值。土壤环境背景值是指该地区未受或少受人类活动（特别是人为污染）影响的土壤环境本身的各种化学元素组成及其含量。它是一个相对的概念（A对），只能表示在相对不受污染情况下，环境要素的基本化学组成（B对）。同一环境要素在不同的地理、地质环境中，自然背景值是不同的（D错，为本题正确答案）。化学元素含量超过了环境背景值和能量分布异常，表明环境可能受到了污染（E对）。在未受污染影响的情况下，土壤中化学元素的自然组成及其含量水平，又称环境本底值（C对）。